颏孔位于
A. 下颌体的外侧面
B. 下颌体的内侧面
C. 下颌升支内侧面
D. 下颌角的外面
E. 下颌角的内面

正确答案：A。下颌体的外侧面

解析：颏孔位于下颌体外侧面，成人多位于下颌第二前磨牙或下颌第一、第二前磨牙之间的下方，下颌体上、下缘中点微上方，距正中线约2～3cm。掌握“面部表面解剖”知识点。